最常见的尘肺类型是
A. 矽肺
B. 硅酸盐肺
C. 煤工尘肺
D. 金属尘肺

正确答案：C。煤工尘肺

解析：本题考查最常见的尘肺类型。煤工尘肺是指煤矿作业工人长期吸入生产性粉尘所引起的尘肺的总称。煤工尘肺（C对ABD错）大约占尘肺病总数的50%以上，位居第一，是最常见的尘肺类型，可分为煤肺、矽肺和煤矽肺。